伤寒的典型临床特征为
A. 持续发热
B. 相对缓脉
C. 反应迟钝
D. 玫瑰疹与白细胞减少
E. 以上全是

正确答案：E。以上全是